为了早期发现某社区内糖尿病患者，以便实施干预措施，应该采用哪种调查方法
A. 普查
B. 抽样调查
C. 前瞻性调查
D. 回顾性调查
E. 个案调查

正确答案：A。普查